对原有修复体的检查包括
A. 原义齿与口腔组织的密合情况
B. （牙合）关系
C. 外形是否合适
D. 义齿行使功能的效率
E. 以上都对

正确答案：E。以上都对

解析：原有修复体的检查：患者如配戴有修复体，应了解患者要求重做的原因，检查原义齿与口腔组织的密合情况，咬合关系是否正确，外形是否合适，义齿对牙龈、黏膜有无刺激以及该义齿行使功能的效果如何等。分析评价原修复体的成功与失败之处，并作为重新制作时的参考。值得注意的是，对年老体弱、全身健康状况差，特别是有严重心血管疾病患者的检查，动作要轻巧，尽量缩短操作和就诊时间。掌握“修复学临床检查”知识点。